男性，31岁。1年来疑被人迫害、数次出走后被家人找回。近半年来常行为诡秘，将家中闹钟、收音机等在半夜深埋在公园树林地下，对亲友冷淡，生活懒散，房间内藏有刀棍等，体格检查无阳性发现。精神状况检查：接触被动，有自语自笑，衣着尚得体。其称“有人要谋害我”“有人命令我要么自杀、要么逃出去。”否认有病，无知力。该患者急性期主要治疗措施是
A. 药物治疗
B. 胰岛素休克疗法
C. 电休克疗法
D. 心理治疗
E. 行为治疗

正确答案：A。药物治疗